过去曾称“圆柱瘤”的是
A. 沃辛瘤
B. 多形性腺瘤
C. 腺样囊性癌
D. 腺泡细胞癌
E. 黏液表皮样癌

正确答案：C。腺样囊性癌

解析：腺样囊性癌过去曾称“圆柱瘤”，也是最常见的唾液腺恶性肿瘤之一。掌握“腺样囊性癌”知识点。